双人复苏时，心脏按压与口对口人工呼吸的比例是
A. 4:1
B. 5:1
C. 6:1
D. 10:1
E. 30:2

正确答案：E。30:2

解析：根据2010年AHA复苏指南，对于成人的心跳呼吸停止，不管是单人还是双人实施复苏，心脏按压与呼吸比均为30：2（E对）。只有对于儿童和婴儿的复苏，且当施救者为两名专业人员时，按压与口对口人工呼吸比例是15：2。需注意：传统观点认为（1992年AHA复苏指南、黄家驷外科学P347），单人复苏时，心脏按压15次施行人工呼吸2次（15：2）；双人复苏时，心脏按压5次施行人工呼吸1次（5：1），此观点已过时。